上颌横（牙合）曲线由哪些牙尖的连线所构成
A. 左右两侧磨牙舌尖的连线
B. 左右两侧双尖牙的颊尖、舌尖的连线
C. 左右两侧磨牙颊尖、舌尖的连线
D. 左右两侧磨牙颊尖的连线
E. 左右两侧双尖牙舌尖的连线

正确答案：C。左右两侧磨牙颊尖、舌尖的连线

解析：横（牙合）曲线：又称Wilson曲线。上颌两侧磨牙在牙槽中的位置均略向颊侧倾斜，使舌尖的位置低于颊尖，因此，连接两侧同名磨牙的颊尖、舌尖形成一条凸向下的曲线，称横（牙合）曲线。掌握“牙列”知识点。